不能利用脂肪酸的组织是
A. 肝脏
B. 肾脏
C. 肌肉
D. 脑组织
E. 心肌

正确答案：D。脑组织